下列关于阴道假丝酵母菌病的描述，正确的是
A. 主要是直接传染
B. 孕妇与非孕妇发生率大体相同
C. 白带增多，灰白色，稀薄泡沫状
D. 多见于长期服用安宫黄体酮的妇女
E. 有白假丝酵母菌感染的阴道PH值为4.0～4.7

正确答案：E。有白假丝酵母菌感染的阴道PH值为4.0～4.7

解析：外阴阴道假丝酵母菌病是由假丝酵母菌引起的一种外阴阴道炎症，有白色假丝酵母菌感染的阴道pH为4.0-4.7，通常<4.5（E对）。其感染途径主要为内源性传染，而非直接传染（A错），长期服用避孕药物、妊娠期妇女、有糖尿病史、接受大剂量雌激素治疗、长期大量应用抗生素及肾上腺皮质激素、严重传染病、消耗性疾病以及B族维生素缺乏者，均为有利于假丝酵母菌繁殖的条件，其发生与机体抵抗力下降有关，阴道内酸性增强是，可迅速繁殖而引起炎症，故在妊娠等抵抗力下降或阴道内环境改变时，假丝酵母菌病更易发生，孕妇与非孕妇发生本病的机率不同（B错），黄体酮为孕激素，阴道假丝酵母菌病多见于长期大剂量服用雌激素治疗者（D错）。其主要表现为白带增多，呈豆腐渣样或白色凝乳状，略带腥臭味，而非灰白色稀薄泡沫状增多的阴道分泌物（C错）。